以下哪一项是皮样、表皮样囊肿所具有的特征
A. 一般无自觉症状
B. 多见于儿童、青年
C. 生长缓慢
D. 胚胎发育时期遗留于组织中的上皮细胞发展而形成
E. 以上都是

正确答案：E。以上都是

解析：多见于儿童及青年。皮样囊肿好发于口底、颏下，表皮样囊肿好发于眼睑、额、鼻、眶外侧、耳下等部位。生长缓慢，呈圆形。皮样囊肿常位于黏膜或皮下较深的部位或口底诸肌之间。囊膜表面的黏膜或皮肤光滑，囊肿与周围组织、皮肤或黏膜均无粘连，触诊时囊肿坚韧而有弹性，似面团样。掌握“皮脂腺、皮样或表皮样囊肿”知识点。